暴露因素和人群健康效应已基本清楚，要研究暴露-反应关系，可以利用的方法是
A. 群组研究
B. 病例对照研究
C. 现况调查研究
D. 动物实验研究
E. 以上均不对

正确答案：C。现况调查研究

解析：本题考查现况调查研究。现况调查研究（C对ABDE错）是一种常见的研究方法，它可以收集大量的数据，以便研究暴露与反应之间的关系。它可以比较暴露和未暴露的人群，从而更好地了解暴露对人群健康的影响。此外，它还可以同时考虑多种因素，以便更准确地识别关联，从而更有效地阐明暴露与反应之间的关系。